男孩，10个月，因高热7天伴皮疹来院。查体：发育正常，皮肤可见红色斑疹，右颈部淋巴结1.5cm×2cm，咽红，扁桃体Ⅰ度，口唇干红，双肺呼吸音清，心尖区可闻及2/6SM，腹软，肝、脾不大，四肢末端红肿。实验室检査：HB100g/L，WBC13×109/L，N0.78，L0.22，PLT352×109/L，ESR70mm/h，ERP（+），ASO100U。本病例最可能的诊断是
A. 颈淋巴结炎
B. 金黄色葡萄球菌败血症
C. 风湿性心脏炎
D. 病毒性心肌炎
E. 川崎病

正确答案：E。川崎病

解析：发热5天以上，伴下列5项临床表现中4项者即可诊断川崎病：（1）四肢变化：掌跖红斑，手足硬性水肿，恢复期指（趾）端膜状脱皮（2）多形性红斑（3）眼结合膜充血（4）口唇充血皲裂，口腔黏膜弥漫充血，舌乳头呈草莓舌（5）颈部淋巴结肿大掌握“川崎病”知识点。